引起COPD的重要发病因素是
A. 吸烟
B. 感染
C. 空气污染
D. 职业性粉尘
E. 蛋白酶-抗蛋白酶失衡

正确答案：A。吸烟